驾驶员禁用的药有
A. 依那普利
B. 右美沙芬
C. 奥美拉唑
D. 金刚烷胺
E. 双嘧达莫

正确答案：B、C、D、E。右美沙芬；奥美拉唑；金刚烷胺；双嘧达莫

解析：本题考查驾驶员用药。驾驶员禁用的药有右美沙芬（B对）、奥美拉唑（C对）、金刚烷胺（D对）、双嘧达莫（E对）。奥美拉唑偶见有疲乏、嗜睡。右美沙芬、金刚烷胺、双嘧达莫可使驾驶员出现眩晕或幻觉。以上药物驾驶员应慎用。依那普利（A错）为血管紧张素转换酶抑制剂（ACEI），用于治疗高血压。